临床试验中，采用随机化分组，是为了
A. 使试验更有代表性
B. 使试验结论更可靠
C. 使试验组和对照组人数相等
D. 平衡两组间的混杂因素
E. 平衡试验因素对试验组和对照组的作用

正确答案：D。平衡两组间的混杂因素

解析：本题考查实验流行病学中随机化的目的。在实验研究中，遵循随机化原则，将研究对象随机分配到实验组和对照组，使每个研究对象都有同等的机会被分配到各组去，以平衡实验组和对照组各种已知和未知的混杂因素（D对ABCE错），从而提高两组的可比性，避免造成偏倚。